对髋关节有旋内作用的肌
A. 髂腰肌
B. 臀大肌
C. 臀中肌
D. 梨状肌
E. 闭孔内肌

正确答案：C。臀中肌

解析：髂腰肌（A错）使髋关节前屈和旋外，下肢固定时，可使躯干前屈；臀大肌（B错）使髋关节伸和旋外；臀中肌（C对）使髋关节外展、旋内和旋外；梨状肌（D错）使髋关节外展和旋外；闭孔内肌（E错）使髋关节旋外。